x10⁹/L，中性粒细胞占90%，脑脊液涂片发现革兰阴性双球菌。病人四肢厥冷，口唇发绀，面色苍白，确诊后，立即给青霉素抗感染，此外还应给哪种药治疗
A. 肾上腺素
B. 多巴胺
C. 去甲肾上腺素
D. 阿托品
E. 东莨菪碱

正确答案：D。阿托品

解析：患者被诊断为肺炎双球菌感染，所以使用了抗菌药青霉素，但是患者现在已经产生休克症状，所以应合用阿托品，因为阿托品是感染性中毒性休克的首选药。